46岁妇女，近半年月经周期延长，经量减少，现停经2个月，出现阵发性的潮热出汗，伴有夜间睡眠不佳等症状。该妇女最可能的诊断是
A. 结核
B. 神经症
C. 绝经
D. 更年期综合征
E. 多囊卵巢综合征

正确答案：D。更年期综合征

解析：本题考查更年期综合征的主要症状。该46岁妇女，近半年月经周期延长，经量减少，现停经2个月，出现阵发性的潮热出汗，伴有夜间睡眠不佳等症状可推断出这位妇女是属于更年期综合（D对ABCE错）。更年期综合征的主要临床表现包括（1）血管舒缩失调症状：①潮红、潮热和出汗；②高血压：以收缩压升高为主，具有明显波动性；③假性心绞痛。（2）神经心理症状：易激动、急躁、焦虑、抑郁、失眠、记忆力减退、注意力不集中、皮肤刺痒、麻木或蚁行感。（3）一般症状：①肌肉、关节痛：常在受寒、受累时出现肩、颈、腰背部痛；②泌尿生殖系统症状：尿频、尿痛、排尿困难、阴道干燥及烧灼感、性交痛及性交困难等；③代谢改变引起的症状：面部及双下肢水肿和单纯性肥胖，尿糖和血糖增高等。